实施脑死亡标准的直接伦理目的是
A. 减轻家属的身心痛苦
B. 促进人体器官移植
C. 维护死者的尊严
D. 节约卫生资源
E. 尊重患者死亡的权利

正确答案：C。维护死者的尊严

解析：实施脑死亡标准的直接伦理目的是：①使死亡标准更趋于科学化，指导医生正确地实施复苏与抢救，确定准确的死亡时间，减少法律纠纷；②在伦理学上维护死者的尊严（C对）。对已无生还希望的脑死亡者机械地维持呼吸与循环，是对尸体的侵犯。实施脑死亡标准的间接伦理目的是：①有利于卫生资源的合理分配；②有助于缓解供体器官短缺的情况，使更多病人得以救治生存。